ANUG是一种由多种微生物引起的
A. 医源性感染
B. 接触性感染
C. 病原性感染
D. 机会性感染
E. 多发性感染

正确答案：D。机会性感染

解析：ANUG（急性坏死性溃疡性龈炎）是一种由多种微生物引起的机会性感染，在局部抵抗力降低的组织和宿主，这些微生物造成ANUG病损。掌握“坏死性溃疡性龈炎”知识点。